结构类型为多肽的化合物是
A. 斑蝥素
B. 胆酸
C. 麝香酮
D. 水蛭素
E. 牛磺酸

正确答案：D。水蛭素

解析：本题考查的是水蛭中的主要化学物质。结构类型为多肽的化合物是水蛭素（D对）。水蛭主含蛋白质，含有17种氨基酸，水解氨基酸含量达49.4%，包括人体必需的8种氨基酸，其中谷氨酸含量高达8.3%；还含有Zn、Mn、Fe、Co、Cr、Se、Mo、Ni等14种微量元素。水蛭素是水蛭的主要有效药用成分，是一种含有65个氨基酸残基的单链多肽。斑蝥素（A错）为斑蝥的主要化学成分。斑蝥中主要含单萜类成分：斑蝥素，还含脂肪、树脂、蚁酸及多种微量元素等。斑蝥素是其有效成分，也是毒性成分。《中国药典》规定，斑蝥含斑蝥素不得少于0.35%。胆酸（B错）与牛磺酸（E错）为牛黄的主要化学成分。牛黄约含8%胆汁酸，主要成分为胆酸、去氧胆酸和石胆酸。此外，还含有7%SMC及胆红素，胆固醇，麦角固醇，多种氨基酸（如丙氨酸、甘氨酸、牛磺酸、精氨酸、天冬氨酸、蛋氨酸等）和无机盐等。《中国药典》以胆酸和胆红素为牛黄的质量控制成分，要求胆酸含量不少于4.0%，胆红素含量不得少于25.0%。麝香酮（C错）为麝香的主要化学成分。麝香的化学成分较为复杂，其中的麝香酮（L-3-甲基十五环酮）是天然麝香的有效成分之一。《中国药典》以麝香酮为指标成分进行含量测定，要求麝香酮含量不得少于2.0%。此外，麝香中还含有降麝香酮，麝香吡啶和羟基麝香吡啶A、B等10余种雄甾烷衍生物，而且还有多肽、脂肪酸、胆甾醇及其酯和蜡等。